某男，1岁。食欲不振，嗳腐酸馊，偶见呕吐食物，脘腹胀满，大便酸臭，夜眠不安，手足心热；舌红苔黄厚腻，指纹紫滞。应采用的治法是
A. 健脾助运，消食化滞
B. 健脾益气，清热通腑
C. 和胃消食，清化湿热
D. 健脾益气，佐以助运
E. 消乳化食，和中导滞

正确答案：E。消乳化食，和中导滞

解析：本题考查的是积滞的辨证论治。某男，1岁。食欲不振，嗳腐酸馊，偶见呕吐食物，脘腹胀满，大便酸臭，夜眠不安，手足心热；舌红苔黄厚腻，指纹紫滞。应采用的治法是消乳化食，和中导滞（E对）。积滞，是指小儿内伤乳食，停聚中焦，积而不化，气滞不行所致的疾病，以脘腹胀满、嗳气酸腐、不思乳食、食而不化、大便溏薄或秘结酸臭为临床特征。（一）乳食内积证：【症状】不思乳食，嗳腐酸馊，或呕吐食物、乳片，脘腹胀满疼痛，大便酸臭或便秘，烦躁啼哭，夜眠不安，手足心热。舌质红，苔白厚，或黄厚腻，脉弦滑，或指纹紫滞。【治法】消乳化食，和中导滞。（二）脾虚夹积证：【症状】面色萎黄，形体消瘦，神疲肢倦，不思乳食，食则饱胀，腹满喜按，大便溏稀酸腥，夹有乳片或不消化食物残渣。舌质淡，苔白腻，脉细滑，或指纹淡滞。【治法】健脾助运，消食化滞（A错）。厌食脾胃气虚证：【症状】不思进食，食不知味，神倦多汗，大便溏薄夹不消化食物，面色少华，形体偏瘦，肢倦乏力。舌淡，苔薄白，脉缓无力。【治法】健脾益气，佐以助运（D错）。